以下有关牙骨质结构的临床意义，以下内容说法错误的是
A. 继发性牙骨质可以弥补咬合的磨损
B. 牙根表面的小缺损可以通过继发性牙骨质来进行修复
C. 继发性牙骨质与原有的牙骨质之间无明显分界
D. 乳恒牙交替时，牙骨质有吸收
E. 修复中的牙骨质可以为细胞牙骨质或非细胞牙骨质

正确答案：C。继发性牙骨质与原有的牙骨质之间无明显分界

解析：牙骨质可以通过不断的增生和沉积使得牙齿的（牙合）面磨损得到一定的补偿。当牙根表面有小范围的病理性吸收或牙骨质折裂时，均可由继发性牙骨质的沉积而得到修复。在新形成的牙骨质与原有吸收区的牙骨质之间有一深染的分界线。修复中形成的牙骨质依照其形成速度快慢可以为细胞牙骨质和无细胞牙骨质。在乳恒牙交替，或根尖有炎症和创伤时，则可以导致牙骨质的吸收，这种吸收甚至还可以波及牙本质。掌握“牙骨质”知识点。